评价某致病因素对人群危害程度使用
A. RR
B. AR
C. PAR
D. ARP
E. 死亡比例

正确答案：C。PAR